内源性Ag诱导的免疫应答中，需识别MHCⅠ类分子，这种细胞是
A. Th1
B. Th2
C. Mφ
D. CD8⁺T
E. 嗜碱性粒细胞

正确答案：D。CD8⁺T